对消毒防腐药苯酚耐药的病原微生物是
A. 球菌
B. 双球菌
C. 杆菌
D. 真菌
E. 病毒

正确答案：E。病毒

解析：本题考查消毒防腐药。对消毒防腐药苯酚耐药的病原微生物是病毒（E对）。苯酚的杀菌作用强，但对病毒和芽孢无效。病毒对碱类敏感，对苯酚耐药，真菌对羟苯乙酯敏感，对氧化剂不敏感。其他选项为干扰项。